低聚糖含有的糖几个数的范围是
A. 2～9个
B. 20～70个
C. 20～80个
D. 20～90个
E. 20～100个

正确答案：A。2～9个

解析：本题考查的是低聚糖的定义。低聚糖含有的糖几个数的范围是2～9个（A对）。由2～9个单糖通过苷键结合而成的直链或支链聚糖称为低聚糖。由10个以上（BCDE错）单糖通过苷键连接而成的糖称为多聚糖或多糖。